六淫邪气中，具有“阻遏气机”特点的是
A. 风
B. 暑
C. 湿
D. 寒
E. 火

正确答案：C。湿

解析：风为阳邪，其致病具有善动不居、轻扬开泄的特性，易袭阳位，风善行而数变，故致病病位游走不定，病情变幻无常，发病迅速；风性主动，故致病具有动摇不定的特征；风为百病之长，寒、热、暑、湿、燥邪易依附风邪侵犯人体（A错）。暑为阳邪，其致病具有炎热、升散的特性，能扰神伤津耗气，多挟湿邪（B错）。湿邪为阴邪，致病具有重浊、黏滞、趋下的特性，易损伤阳气，阻遏气机。湿为重浊有质之邪，侵入人体最易留滞于脏腑经络，阻遏气机（C对）。寒邪为阴邪，其致病具有寒冷、凝结、收引的特性，易伤阳气（D错）。火为阳邪，其致病具有炎热升腾的特性，其性燔灼趋上，易扰心神，易耗气伤津、生风动血，易致疮痈（E错）。